下列疾病中较少发生急性肝衰竭的是
A. 药物性肝病
B. 慢性乙型肝炎
C. 右半肝切除术后
D. 非酒精性脂肪性肝病
E. 四氯化碳中毒

正确答案：D。非酒精性脂肪性肝病

解析：在我国，引起肝衰竭的首要因素是乙型肝炎病毒（B错），急性肝衰竭可由药物（A错）、肝毒性物质（E错）、病毒、酒精等因素诱发的一组临床综合征。右半肝切除术后可出现肝功能急剧恶化（C错）。非酒精性脂肪性肝病多数预后较好，很少发生急性肝衰竭（D对）。